某食物中钙的INQ值大于1表示
A. 食物钙的供给能力高于能量
B. 食物钙的供给能力低于能量
C. 食物钙的供给能力等于能量
D. 食物钙的供给量高于机体所需
E. 食物钙的供给量低于机体所需

正确答案：A。食物钙的供给能力高于能量

解析：本题考查营养质量指数（INQ）。营养质量指数（INQ）是指某食物中营养素能满足人体营养需要的程度（营养素密度）与该食物能满足人体能量需要的程度（能量密度）的比值。当INQ＞1时，表示该食物营养素的供给能力高于能量（A对BCDE错），当人们摄入该种食物时，满足营养素需要的程度大于满足能量需要的程度。